上皮釉是口腔上皮与以上哪种结构相结合所形成
A. 缩余釉上皮
B. 牙囊
C. 星网状层
D. 口腔上皮
E. 马拉瑟上皮剩余

正确答案：A。缩余釉上皮

解析：本题考查牙体、牙周组织的形成。当牙齿突破骨隐窝以及其上方的结缔组织后，缩余釉上皮（A对）将与口腔上皮相接触并与之紧密结合成为一融合的双侧上皮覆盖在牙冠上方，并移动到退变的结缔组织处，称为上皮釉。